在肱骨中、下1/3交界处骨折时，可能引起哪些肌群瘫痪
A. 臂及前臂后群肌
B. 前臂后群及前臂前群肌
C. 前臂后群肌
D. 前臂后群前臂外侧群肌
E. 前臂前群肌

正确答案：C。前臂后群肌

解析：肱骨中、下1/3交界处骨折时容易损伤桡神经沟导致桡神经受损，导致前臂后肌群（C对）的瘫痪。